生物-心理-社会医学模式的含义不正确的是
A. 揭示了医学观的动态性
B. 肯定了生物医学的价值
C. 确立了社会、心理因素的重要地位
D. 立体地探索了健康观念
E. 彻底揭示了医学问题

正确答案：E。彻底揭示了医学问题